对慢性肾小球肾炎患者不宜采取哪项措施
A. 低钠饮食
B. 高蛋白饮食
C. 低蛋白饮食
D. 积极控制血压
E. 低磷饮食

正确答案：B。高蛋白饮食

解析：慢性肾小球肾炎时要求饮食限盐，肾功能不全者还应控制蛋白摄入量及限磷；积极控制血压；避免劳累、感染、妊娠及应用肾毒性药物。掌握“慢性肾小球肾炎、肾病综合征”知识点。